男性，曾有云南旅居史，高热，热退后再次高热，考虑可能是什么病
A. 疟疾
B. 血吸虫
C. 登革热
D. 钩端螺旋体
E. 艾滋病

正确答案：A。疟疾

解析：男性，曾有云南旅居史（疟疾流行区），高热，热退后再次高热（疟疾的临床表现），可以诊断为疟疾（A对）；钩端螺旋体病多为稽留热（D错）。